国家颁布对办公建筑物空气质量提出了具体要求的标准是
A. 《大气卫生标准》
B. 《大气环境质量标准》
C. 《住宅卫生标准》
D. 《室内空气质量标准》
E. 《办公建筑物卫生标准》

正确答案：D。《室内空气质量标准》

解析：本题考查国家颁布的对办公建筑物空气质量要求的标准。国家颁布对办公建筑物空气质量提出了具体要求的标准是《室内空气质量标准》（D对ABCE错）。